药品标准是哪些部门必须共同遵守的标准
A. 药品生产部门和药品管理部门
B. 药品经营场所
C. 药品供应商
D. 药品使用者和药品检验场所
E. 以上都是

正确答案：E。以上都是

解析：本题考查药品标准。药品标准是药品生产部门和药品管理部门、药品经营场所、药品供应商、药品使用者和药品检验场所必须共同遵守的标准，所以以上都是（E对）。药品标准是指国家对药品质量规格及检验方法所做的技术性规范，由一系列反映药品特征的参数和技术指标组成，是药品生产、经营、供应、使用、检验和管理部门必须共同遵循的法定依据。